2005年5月，某县的A药品生产企业在K疫苗（第二类疫苗）生产、销售过程中，采用偷工减料、弄虚作假等手段逃避监督管理，致使若干人份的效价不符合规定的产品流向市场，有证据证明已造成接种人员健康的严重伤害后果。药品监督管理部门依据《药品管理法》有关规定，没收A企业违法生产、销售的该批K疫苗和违法所得，并依法从重处罚，罚没共计2500余万元。同时、撒销A企业K疫苗的药品批准证明文件，直接负责的主管人员和其他责任人员被移送司法机关追究相关责任。本案中，对直接负责的主管人员和直接责任人员追究行政责任为
A. 十年内不得从事药品生产，经营活动
B. 三年内不得从事药品生产，经营活动，并处罚款
C. 二十年内不得从事药品生产，经营活动
D. 终身不得从事药品生产、经营活动

正确答案：D。终身不得从事药品生产、经营活动

解析：本题考查药品经营管理要求的法律责任。根据《药品管理法》第一百一十八条第一款规定，生产、销售假药，对法定代表人、主要负责人、直接负责的主管人员和其他责任人员，没收违法行为发生期间自本单位所获收入，并处所获收入百分之三十以上三倍以下的罚款，终身禁止从事药品生产经营活动（D对）。